男，1岁。发热、咳嗽3天。今日突然出现气促、呼吸困难，紫绀，面色苍白，心率增快达180次/分，两肺闻及细湿啰音和哮鸣音，肝肋下3厘米。最可能合并的疾病是
A. 急性心力衰竭
B. 艾森曼格综合征
C. 脓胸
D. 气胸
E. 心肌炎

正确答案：A。急性心力衰竭

解析：患儿，有发热、咳嗽的临床表现，以及两肺可闻及粗湿啰音和哮鸣音，应诊断为支气管肺炎。近日突然有气促、呼吸困难、紫绀、面色苍白、心率增快达180次/分、肝脏增大的症状，因此该患儿最可能合并的疾病是急性心力衰竭（A对）。艾森曼格综合征虽然也会有紫绀，但不会有心率加快，肝脏增大的症状（B错）。假如该患儿合并有脓胸和气胸，听诊的体征不会是粗湿啰音（C错）和哮鸣音（D错），而是患侧呼吸音减弱。心肌炎患者一般会有3周左右的上感史，该患儿的上感史只有3天，所以该患儿不是合并心肌炎（E错）。